男，30岁，寒战，高热，咳铁锈色痰3天，加重1天，查体：右下肺可闻及湿啰音，痰培养：肺炎链球菌（+），影像学提示右肺下野大片致密阴影。右肺病灶处肺泡腔内的主要成分是
A. 浆液和红细胞
B. 中性粒细胞和纤维素
C. 纤维素和红细胞
D. 浆液和巨噬细胞
E. 淋巴细胞和纤维素

正确答案：C。纤维素和红细胞

解析：充血水肿期：发病的第1-2天，病变肺叶肿胀，暗红色。镜下见肺泡间隔内毛细血管弥漫性扩张充血，肺泡腔内有大量的浆液性渗出液，其内混有少量的红细胞、中性粒细胞和巨噬细胞（AD错）。红色肝样变期 一般于发病后的第3-4天，肿大的肺叶充血呈暗红色，质地变实，切面灰红似肝脏外观，故称红色肝样变期。镜下见肺泡间隔内毛细血管仍处于扩张充血状态，而肺泡腔内则充满纤维素及大量红细胞，其间夹杂少量中性粒细胞和巨噬细胞（C对BD错）。灰色肝变样期：纤维素网中有大量中性粒细胞，因肺泡壁毛细血管受压迫，肺泡腔内几乎很少见到红细胞（B错）。溶解消散期：发病后1周左右进入该期 此时机体的防御功能显著增强，病菌消灭殆尽。肺泡腔内中性粒细胞变性坏死，并释放出大量蛋白水解酶将渗出物中的纤维素溶解，由淋巴管吸收或经气道咳出。